以下健康教育的主要任务正确的是
A. 建立或促进个人和社会对预防疾病和促进健康的大局观和全局责任感
B. 促进个体和社会作出决策，选择自己最喜欢的健康行为
C. 有效地促进全社会都来关心健康以及疾病预防问题
D. 对卫生专业人员及有关人员进行健康教育原则及实践方面的培训
E. 对老年人进行急救培训，减少突发疾病死亡率

正确答案：C。有效地促进全社会都来关心健康以及疾病预防问题